测定垂直距离采用
A. 牙尖交错位
B. 正中（牙合）位
C. 正中关系位
D. 下颌姿势位
E. 后退接触位

正确答案：D。下颌姿势位

解析：本题考查颌位。测定垂直距离采用下颌姿势位（D对）。（1）当人直立或端坐，两眼平视前方，不咀嚼、不吞咽、不说话时，提颌肌群轻微收缩以对抗下颌骨所承受的重力，上下颌牙之间有一前大后小的楔形间隙，约2～4mm，称为息止（牙合）间隙，此时下颌所处的位置称为下颌姿势位（MPP）。（2）垂直距离也称为面下1/3高度，用鼻底到软组织颏下点之间的距离表示。（3）姿势位时的垂直距离与ICP时的垂直距离之差即为息止（牙合）间隙大小。